具有氨基醇结构的β受体阻滞剂
A. 盐酸地尔硫䓬
B. 硝苯吡啶
C. 盐酸普萘洛尔
D. 硝酸异山梨酯
E. 盐酸哌唑嗪

正确答案：C。盐酸普萘洛尔

解析：本题考查盐酸普萘洛尔。盐酸普萘洛尔（C对）是具有氨基醇结构的β受体阻滞剂。盐酸地尔硫䓬（A错）为非二氢吡啶类钙离子拮抗剂，结构为硫氮杂䓬。硝苯吡啶（B错）为二氢吡啶类钙离子拮抗剂。硝酸异山梨酯（D错）具有酯类结构，可用于扩张血管。盐酸哌唑嗪（E错）为喹唑啉的衍生物，选择性阻断α受体。